关于社区卫生服务的概念，下列不正确的描述是
A. 是社区服务中一种基本的卫生服务
B. 强调政府领导、社会参与
C. 以基层卫生机构为主体，以全科医生为服务的主干力量
D. 以需要为导向，提供无偿服务
E. 以解决慢性病和常见病为目标

正确答案：D。以需要为导向，提供无偿服务